对所有癫痫类型都有效的广谱抗癫痫药是
A. 乙琥胺
B. 苯巴比妥
C. 丙戊酸钠
D. 苯妥英钠
E. 安定

正确答案：C。丙戊酸钠

解析：本题考查丙戊酸钠。对所有癫痫类型都有效的广谱抗癫痫药是丙戊酸钠（C对）。丙戊酸钠为一广谱抗癫痫药，临床用于各型癫痫，对失神性发作（小发作）疗效最好。乙琥胺（A错）仅对失神发作（小发作）有效，为首选药。苯巴比妥（B错）治疗癫痫大发作和癫痫持续状态，对局限性发作也有效，但不作为首选。苯妥英钠（D错）为治疗大发作和局限性发作的首选药，对复杂部分性发作和单纯部分性发作有一定疗效。安定（E错）具有镇静、抗惊厥等作用，一般不用于癫痫治疗。